情绪的功能包括
A. 情绪是心理活动的组织者
B. 情绪是人际交往的重要手段
C. 情绪是适应生存的心理工具
D. 激发心理活动和行为的动机
E. 以上说法均正确

正确答案：E。以上说法均正确

解析：情绪的功能：情绪是适应生存的心理工具；激发心理活动和行为的动机；情绪是心理活动的组织者；情绪是人际交往的重要手段。掌握“情绪过程”知识点。